患者女，25岁，左上2为过小畸形牙，牙体制备后拟完成金属一烤瓷全冠修复体，制取印模时选用的最佳印模材料是
A. 藻酸钾
B. 藻酸钠
C. 印模膏
D. 硅橡胶
E. 琼脂

正确答案：D。硅橡胶

解析：硅橡胶目前已经成为固定义齿常规的取模材料，取模准确，操作简便，精确度高。掌握“暂时冠及印模与模型”知识点。